牙石致病机制中最主要的是
A. 压迫牙龈
B. 妨碍口腔卫生的保持
C. 吸附细菌毒素
D. 粗糙表面的机械刺激
E. 牙石表面未钙化的菌斑

正确答案：E。牙石表面未钙化的菌斑

解析：本题考查牙周疾病促进因素。牙石本身对牙龈可能具有一定机械刺激，但研究结果排除了牙石本身作为牙周病原始病因的可能性，牙石的致病作用是继发的，为菌斑的进一步积聚和矿化提供理想的表面。牙石对牙周组织的主要危害来自其表面堆积的菌斑（E对），由于牙石的存在使得菌斑与组织表面紧密接触，引起组织的炎症反应。此外，牙石的多孔结构也容易吸收大量的细菌毒素，牙石也妨碍口腔卫生措施的实施。